下列关于黏液表皮样癌的描述，错误的是
A. 约2/3的黏液表皮样癌发生在腮腺
B. 有的无包膜而向周围组织浸润
C. 低分化型常见颈淋巴结转移
D. 血行转移多见，且多转移至肝脏
E. 高分化型生长慢，转移率低，预后较佳

正确答案：D。血行转移多见，且多转移至肝脏

解析：本题考查黏液表皮样癌。高分化黏液表皮样癌血行性转移很少见（D错，为本题的正确答案）。黏液表皮样癌是唾液腺恶性肿瘤中最常见者。黏液表皮样癌约2/3的黏液表皮样癌发生在腮腺（A对），其次为腭部和下颌下腺，也可发生于其他小唾液腺。在手术中可以发现，肿瘤常无包膜或包膜不完整，向周围组织浸润（B对）。低分化黏液表皮样癌淋巴结转移率高，常见颈淋巴结转移（C对），且可出现血行性转移。高分化型黏液表皮样癌呈无痛性肿块、生长缓慢，很少发生颈淋巴结转移，血行性转移更少见，预后较佳（E对）。